女，68岁。近3个月来常有粘液血便，大便次数增多，有肛门坠胀及里急后重感，大便变细，上述症状进行性加重，查体：生命征平稳，腹部无明显阳性体征，血、尿常规均正常。患者未经积极治疗，3个月后出现膀胱刺激症状，最可能的原因是
A. 膀胱原发肿瘤
B. 淋巴转移
C. 血行转移
D. 种植转移
E. 直接浸润

正确答案：E。直接浸润

解析：患者有肛门坠胀及里急后重感（直肠刺激症状），大便次数增多（排便习惯改变），大便变细并呈进行性加重（符合直肠癌典型症状），应该考虑为直肠癌。直肠与膀胱相距较近，出现膀胱刺激症状，最可能的原因是肿瘤直接浸润（E对）至膀胱。患者血、尿表现异常，直肠症状出现在膀胱刺激征之前，可排除膀胱原发肿瘤（A错）。肿瘤淋巴转移表现为淋巴结肿大，不会出现膀胱刺激征（B错）。血行转移（C错）多见于肝、肺、骨和脑。上段直肠癌种植转移（D错）易至腹膜，不转移到膀胱。